水体复氧作用是指
A. 水中溶解氧为不饱和状态时，空气中的氧不断地溶解在地面水的过程
B. 水中溶解氧为饱和状态时，空气中的氧不断地溶解在地面水的过程
C. 水中溶解氧为饱和状态时，水中氧逐渐逸散到空气中的过程
D. 水中溶解氧为不饱和状态时，水中氧逐渐逸散到空气中的过程
E. 地面水在不同水温条件下所含的氧量

正确答案：A。水中溶解氧为不饱和状态时，空气中的氧不断地溶解在地面水的过程

解析：本题考查水体复氧作用。水体复氧作用是指水中溶解氧为不饱和状态时，空气中的氧不断地溶解在地面水的过程（A对BCDE错）。